新生儿，诊断为单侧完全性唇裂合并单侧完全性腭裂，同时伴有鼻部畸形。最先实施的手术治疗是
A. 新生儿正畸
B. 牙槽突植骨术
C. 唇裂整复术
D. 腭裂整复术
E. 颌骨正畸术

正确答案：C。唇裂整复术

解析：本题考查唇腭裂序列治疗。该病例中患儿为“单侧完全性唇裂合并单侧完全性腭裂”，一般认为，进行唇裂整复术最合适的年龄为3～6月，体重达5～6kg以上。早期进行手术，可以尽早地恢复上唇的正常功能和外形，并可使瘢痕组织减少到最小程度。对伴有牙槽突裂或腭裂的患儿，唇裂整复后，由于唇肌生理运动，可以产生压迫作用，促使牙槽突裂隙逐渐靠拢，为以后的腭裂整复创造条件，所以最先实施唇裂整复术（C对）。新生儿正畸（A错）是指对完全性单侧或双侧腭裂患儿在出生后到3月内戴上腭托矫正器，属于腭裂的正畸治疗，不是手术治疗。牙槽突植骨术（B错）时间多在尖牙萌出前（9～11岁）,此时尖牙牙根已形成1/2到1/3,同时上颌骨基本发育完成，可避免手术对上颌骨生长发育的不良影响。腭裂整复术（D错）多主张早期进行手术，约在8～18个月左右手术为宜。颌骨正畸术（E错）一般在颅面骨生长发育停止后再行手术矫治。